有一年轻男患，在得知自己患了黄疸性肝炎以后，很恐惧。怕女朋友离开他，怕同车间的伙伴疏远他，所以十分恳切地请求医师替他保密。医师看他很值得同情，就决定替他保守这个秘密，但要求他抓紧治疗。不要耽误了病情。题干中医师的这种做法
A. 基本是对的
B. 全部是对的
C. 是错误的
D. 应该得到表扬，因为他很好地处理了矛盾
E. 以上答案均不对

正确答案：C。是错误的

解析：医生在特殊情况下，可以享有干涉患者行为的道德权利。题干中患者患的是烈性传染病，所以题干中医生的做法欠妥。掌握“医患关系伦理”知识点。